许多不利于健康的因素，需要口腔专业人员与全体医务人员一起通过采取控制和改变这些共同危险因素的方法，促进人们的口腔健康和全身健康，此种途径是
A. 制定危险因素预防途径
B. 共同危险因素控制途径
C. 高危人群途径
D. 决策者途径
E. 全民途径

正确答案：B。共同危险因素控制途径

解析：共同危险因素控制途径：许多不利于健康的因素，如不健康的饮食习惯、卫生习惯、吸烟、酿酒以及压力等不仅是口腔健康的危险因素，也是其他慢性病的危险因素，因此，需要口腔专业人员与全体医务人员一起通过采取控制和改变这些共同危险因素的方法，促进人们的口腔健康和全身健康。掌握“口腔健康促进”知识点。